金属全冠戴用2天后，咀嚼时修复牙出现咬合痛，检查有明显叩痛，其原因是
A. 牙髓炎
B. 牙周炎
C. 咬合时有早接触
D. 牙龈炎
E. 接触点过松

正确答案：C。咬合时有早接触

解析：修复体粘固后短期内出现咬合痛：修复体粘固后短期内出现咬合痛，多是由创伤引起。患者有咀嚼痛伴有叩痛，发病病程不长，创伤性牙周炎不严重，通过调牙合，症状就会很快消失。调牙合时根据牙尖交错位及非牙尖交错位的早接触与牙合干扰仔细调整，磨改不合理的陡坡和过锐尖嵴。如调牙合在修复体上进行，应注意抛光。如咬合过高而调牙合困难，预备空间不足导致调雅困难或调牙合修复体过薄，或是粘固时修复体未完全就位者，应拆除修复体重做。掌握“修复体戴入后的问题及处理”知识点。